初孕妇，28岁。妊娠36周，血压升高3周，今晨突然腹痛，呈持续性，阵发性加重。BP150/98mmHg，心率112次/分，尿蛋白（++），阴道少量流血。体格检查最可能发现的子宫体征是
A. 不规则收缩，较硬，有压痛，宫缩间歇子宫不完全松弛
B. 柔软，有压痛，无宫缩
C. 有规律阵发性收缩，宫缩间歇期子宫完全松弛
D. 局部隆起有包块，有压痛
E. 上段硬，下段膨隆压痛，交界处有环形凹陷

正确答案：A。不规则收缩，较硬，有压痛，宫缩间歇子宫不完全松弛

解析：青年初孕妇，妊娠36周（胎盘早剥多发生于20周后），血压升高3周（妊娠期高血压是胎盘早剥发生的高危因素），今晨突然腹痛，呈持续性，阵发性加重，阴道少量流血（胎盘早剥的典型症状为腹痛伴或不伴阴道流血），BP150/98mmHg（血压升高），心率112次/分（正常值为60～100次/分），尿蛋白（++），该孕妇可考虑为Ⅲ度胎盘早剥。因此，临产时最可能发现的子宫体征是不规则收缩，较硬，有压痛，宫缩间歇期子宫不完全松弛（A对）。有规律阵发性收缩，宫缩间歇期子宫完全松弛（P131）（C错）为Ⅰ度胎盘早剥的表现。